呈椭圆形，表面棕色或灰棕色，有13～20条纵向断续突起棱线的药材是
A. 豆蔻
B. 木瓜
C. 益智
D. 砂仁
E. 小茴香

正确答案：C。益智

解析：本题考查的是益智药材的性状鉴别。呈椭圆形，表面棕色或灰棕色，有13～20条纵向断续突起棱线的药材是益智（C对）。益智：【性状鉴别】药材呈椭圆形，两端略尖。表面棕色或灰棕色，有纵向凹凸不平的突起棱线13～20条，顶端有花被残基，基部常残存果梗。果皮薄而稍韧，与种子紧贴，种子集结成团，中有隔膜将种子团分为3瓣，每瓣有种子6～11粒。种子呈不规则的扁圆形，略有钝棱，表面灰褐色或灰黄色，外被淡棕色膜质的假种皮；质硬，胚乳白色。有特异香气，味辛，微苦。豆蔻（A错）：【性状鉴别】药材原豆蔻呈类球形。表面黄白色至淡黄棕色，有3条较深的纵向槽纹，顶端有突起的柱基，基部有凹下的果柄痕，两端均具浅棕色绒毛。果皮体轻，质脆，易纵向裂开，内分3室，每室含种子约10粒；种子呈不规则多面体，背面略隆起，表面暗棕色，有皱纹，并被有残留的假种皮。气芳香，味辛凉，略似樟脑。木瓜（B错）：【性状鉴别】药材长圆形，多纵剖成两半。外表面紫红色或红棕色，有不规则的深皱纹；剖面边缘向内卷曲，果肉红棕色，中心部分凹陷，棕黄色；种子扁长三角形，多脱落。质坚硬，气微清香，味酸。砂仁（D错）：【性状鉴别】药材阳春砂、绿壳砂呈椭圆形或卵圆形，有不明显的三棱。表面棕褐色，密生刺状突起，顶端有花被残基，基部常有果梗。果皮薄而软。种子集结成团，具三钝棱，中有白色隔膜，将种子团分成3瓣，每瓣有种子5～26粒。种子为不规则多面体；表面棕红色或暗褐色，有细皱纹，外被淡棕色膜质假种皮；质硬，断面胚乳灰白色。气芳香而浓烈，味辛凉、微苦。小茴香（E错）：【性状鉴别】药材为双悬果，呈圆柱形，有的稍弯曲。表面黄绿色或淡黄色，两端略尖，顶端残留有黄棕色突起的柱基，基部有时有细小的果梗。分果呈长椭圆形，背面有纵棱5条，接合面平坦而较宽。横切面略呈五边形，背面的四边约等长。有特异香气，味微甜、辛。